为不规则厚片，茎外皮黄绿色、黄棕色或棕褐色，切面髓部常偏向一边的饮片是
A. 干石斛
B. 桑寄生
C. 海风藤
D. 钩藤
E. 槲寄生

正确答案：E。槲寄生

解析：本题考查的是槲寄生饮片的性状特征。为不规则厚片，茎外皮黄绿色、黄棕色或棕褐色，切面髓部常偏向一边的饮片是槲寄生（E对）。槲寄生：【性状鉴别】饮片为不规则的厚片。茎外皮黄绿色、黄棕色或棕褐色。切面皮部黄色，木部浅黄色，有放射状纹理，髓部常偏向一边。叶片黄绿色或黄棕色，全缘，有细皱纹；革质。气微，味微苦，嚼之有黏性。干石斛（A错）为石斛的饮片。干石斛：【性状鉴别】呈扁圆柱形或圆柱形的段。表面金黄色、绿黄色或棕黄色，有光泽，有深纵沟或纵棱，有的可见棕褐色的节。切面黄白色至黄褐色，有多数散在的筋脉点。气微，味淡或微苦，嚼之有黏性。桑寄生（B错）：【性状鉴别】饮片为厚片或不规则短段。外表皮红褐色或灰褐色，具细纵纹，并有多数细小突起的棕色皮孔，嫩枝有的可见棕褐色茸毛。切面皮部红棕色，木部色较浅。叶多卷曲或破碎，完整者展平后呈卵形或椭圆形，表面黄褐色，幼叶被细茸毛，先端钝圆，基部圆形或宽楔形，全缘；革质。气微，味涩。钩藤（D错）：【性状鉴别】药材为带单钩或双钩的茎枝小段。茎枝呈圆柱形或类方柱形。表面红棕色至紫红色者，具细纵纹，光滑无毛；黄绿色至灰褐色者有的可见白色点状皮孔，被黄褐色柔毛。多数枝节上对生两个向下弯曲的钩，或仅一侧有钩，另一侧为突起的疤痕；钩略扁或稍圆，先端细尖，基部较阔；钩基部的枝上可见叶柄脱落后的窝点状痕迹和环状托叶痕。质坚韧，断面黄棕色，皮部纤维性，髓部黄白色或中空。气微，味淡。海风藤（C错）的性状鉴别，2022年考试指南未明确说明。海风藤药材呈扁圆柱形，微弯曲。表面灰褐色或褐色，粗糙，有纵向棱状纹理及明显的节，节部膨大，上生不定根。体轻，质脆，易折断，断面不整齐，皮部窄，木部宽广，灰黄色，导管孔多数，射线灰白色，放射状排列，皮部与木部交界处常有裂隙，中心有灰褐色髓。气香，味微苦、辛。